依照《药品生产质量管理规范（1998年修订）》，《药品生产质量管理规范》适用于原料药生产中影响成品质量的
A. 关键工序
B. 自律性规范
C. 最后工序
D. 全过程
E. 基本准则

正确答案：A。关键工序